清营汤证发热的特点是
A. 夜热早凉
B. 高热不退
C. 身热夜甚
D. 长期低热
E. 白天高热

正确答案：C。身热夜甚

解析：清营汤的发热特点是身热夜甚。由邪热内传营分，耗伤营阴所致。邪热传营，伏于阴分，入夜阳气内归营阴，与热相合，故身热夜甚（C对）。夜热早凉是青蒿鳖甲汤的发热特点（A错）。高热不退是羚角钩藤汤的发热特点（B错）。